以下关于精神障碍医学鉴定的要求主要是
A. 鉴定人应当到收治精神障碍患者的医疗机构面见、询问患者
B. 鉴定人本人或者其近亲属与鉴定事项有利害关系，应当回避
C. 鉴定机构、鉴定人应当遵守有关法律、法规，出具客观、公正的鉴定报告
D. 鉴定人应当对鉴定过程进行实时记录并签名
E. 以上均正确

正确答案：E。以上均正确

解析：精神障碍医学鉴定的要求主要是：①鉴定人应当到收治精神障碍患者的医疗机构面见、询问患者，该医疗机构应当予以配合；②鉴定人本人或者其近亲属于鉴定事项有利害关心，可能影响其独立、客观、公正进行鉴定的，应当回避；③鉴定机构、鉴定人应当遵守有关法律、法规、规章的规定，尊重科学，恪守执业道德，依法独立进行鉴定，出具客观、公正的鉴定报告；④鉴定人应当对鉴定过程进行实时记录并签名。掌握“精神障碍概述、预防、诊断和治疗”知识点。